健脾丸的组成药物中含有
A. 薏苡仁
B. 莱菔子
C. 鸡内金
D. 黄芪
E. 黄连

正确答案：E。黄连

解析：健脾丸中含黄连（E对）。趣记：用蔻三仙，香砂六君山药煎-肉豆蔻+焦三仙+香砂六君丸+山药。